不属于城市生命线系统的是
A. 供水、排水系统
B. 燃料、热力系统
C. 粮油、供电系统
D. 文化、娱乐系统
E. 通信、交通系统

正确答案：D。文化、娱乐系统

解析：本题考查城市生命线系统。生命线系统是指城市供水、排水（A对）、供电、粮油（C对）、燃料、热力（B对）、通信、交通等系统（E对）。文化、娱乐系统（D错，为本题正确答案）不属于城市生命线系统。